患者，男，43岁。眩晕欲仆，头摇肢颤，头痛项强，手足发麻，舌红苔白，脉弦。其证型是
A. 肝阳上亢
B. 肝阳化风
C. 热极生风
D. 血虚生风
E. 阴虚动风

正确答案：B。肝阳化风

解析：肾阴不足，脑窍失养，故见眩晕欲仆；邪热炽盛，燔灼肝经，筋脉挛急，故见头摇肢颤，头痛项强，手足发麻；肝阳化风，故见舌红苔白；肝气失疏，脉气紧张故见脉弦。治法：平肝息风，育阴潜阳。方剂：镇肝息风汤加减（B对）。肝阳上亢症见眩晕耳鸣，头目胀痛，面红目赤，急躁易怒，心悸健忘，失眠多梦，腰膝酸软，口苦咽干，舌红，脉细数等。治宜平肝潜阳，滋阴降火（A错）。热极生风症见身热壮盛，头晕胀痛，两目上翻，手足躁扰，瘛疭，颈项强直，或角弓反张，脉弦数。治宜清热凉肝熄风（C错）。血虚生风症见面色苍白或萎黄，肢体麻木，手足徐徐抽动，筋惕肉瞤，口唇指甲淡白，舌淡苔白，脉弦细。治宜滋阴养血，柔肝熄风（D错）。阴虚动风症见肢麻、震颤、筋挛、头昏、目干、颧红、舌赤少苔、脉细数。治宜滋阴熄风（E错）。